在配对设计差值的符号秩和检验中，已知T+=10.5，T－=34.5，若a=0.05的界值范围为5～40，则作出的统计推断是
A. T+＜40，不拒绝H₀
B. T+＞5，拒绝H₀
C. 5＜T-＜40，不拒绝H₀
D. T-＞5，拒绝H₀
E. T+＞5，T-＜40，不能作出判断

正确答案：C。5＜T-＜40，不拒绝H₀